可经母婴传播的疾病是
A. 细菌性痢疾
B. 伤寒
C. 霍乱
D. 艾滋病
E. 流行性脑脊髓膜炎

正确答案：D。艾滋病

解析：可经母婴传播的疾病是艾滋病（D对）。细菌性痢疾（A错）、伤寒（B错）及霍乱（C错）均主要经粪-口途径传播。流行性脑脊髓膜炎（E错）主要经呼吸道传播。